专有标识为红色椭圆形底英文色标（红底白字）的是
A. 麻醉药品
B. 处方药
C. 甲类非处方药
D. 非处方药
E. 乙类非处方药

正确答案：C。甲类非处方药